可用于检查的杂质为：在实验条件下与硫代乙酰胺形成均匀混悬溶液的方法
A. 氯化物
B. 砷盐
C. 铁盐
D. 硫酸盐
E. 重金属

正确答案：E。重金属